近年有人提出一种肿瘤易发性格模型，指的是哪种性格模型
A. A型性格
B. B型性格
C. C型性格
D. E型性格
E. D型性格

正确答案：C。C型性格